对前列腺的描述中，正确的是
A. 呈底向下的栗子形
B. 内有尿道膜部通过
C. 位于膀胱和尿生殖膈之间
D. 前列腺体的前面有前列腺沟
E. 活体在直肠不能触及

正确答案：C。位于膀胱和尿生殖膈之间

解析：前列腺形似栗子，但底向上（A错）。尿道穿过前列腺的部分为尿道前列腺部（B错），膜部为尿道穿过尿生殖膈的部分。前列腺位于膀胱与尿生殖膈之间（C对）。前列腺体的后面（D错）平坦，中间有一纵行浅沟，称前列腺沟。活体直肠可触及（E错）此沟。